老年糖尿病患者，因慢性根尖周炎在外院治疗长期不愈的原因可能为
A. 根管未彻底清创
B. 未同时使用抗生素
C. 未注意控制血糖
D. 根尖周病变范围大
E. 包括以上各项

正确答案：E。包括以上各项

解析：本题考查糖尿病患者慢性根尖周炎长期不愈的原因。糖尿病是一类常见的内分泌代谢疾病，常见于老年人，和口腔疾病的发生和治疗密切相关。患者机体的免疫力低下，口腔疾病不易愈合，因此该慢性根尖周炎患者治疗前应注意控制血糖（C对），以免导致炎症扩散。如果根管治疗时根管未彻底清创（A对），感染源仍然存在，持续刺激根尖周组织，导致根尖周病变不易愈合。糖尿病属于全身免疫力降低性疾病，根管治疗创伤细菌易进入血液，因此在治疗的同时必须使用抗生素（B对），以控制感染的发生。如果患牙根尖周病变范围大（D对），加上糖尿病患者本身免疫力低下的体质，更易引起慢性根尖周炎长期不愈。（ABCD均对，故E为本题的正确答案）。